以下不属于新生儿期阶段特点的是
A. 新生儿机体发育尚未成熟，适应外界环境的能力较差
B. 是人类独立生活的开始阶段
C. 饮食变化大，由乳类向成人饮食过渡
D. 发病率及死亡率高
E. 应预防各种感染

正确答案：C。饮食变化大，由乳类向成人饮食过渡

解析：新生儿期：自胎儿娩出脐带结扎开始至生后28天内，按年龄划分，此期实际包含在婴儿期之内。特点：①是人类独立生活的开始阶段；②新生儿机体发育尚未成熟，适应外界环境的能力较差；③发病率及死亡率高，尤以早期新生儿（第1周新生儿）最高。应加强护理，注意保暖，细心喂养，预防各种感染。掌握“小儿年龄分期”知识点。